急性苯中毒现场急救的首要措施是
A. 吸氧
B. 人工呼吸
C. 给予急救
D. 保持安静
E. 立即将患者移出现场

正确答案：E。立即将患者移出现场